男孩，10岁，发热8小时，9月10日入院，入院前曾在外面吃烧烤，体温40℃，呼吸24次/分，血压70/40mmHg，查体:浅昏迷，面色苍白，四肢湿冷，皮肤可见“花斑”，检验:WBC24×10⁹/L，N0.9。目前需要立刻处理的是
A. 物理降温
B. 使用糖皮质激素
C. 使用镇静药物
D. 使用血管活性药物
E. 快速补液,积极扩容

正确答案：E。快速补液,积极扩容

解析：青少年男性患者，入院前曾在外面吃烧烤（粪-口传播），体温40℃，呼吸24次/分，血压70/40mmHg，浅昏迷，面色苍白，四肢湿冷，皮肤可见花斑（感染性休克表现），血常规白细胞升高，以中性粒细胞升高为主，结合病史症状体征辅助检查，考虑中毒性菌痢（休克型）。患者目前血流动力学不稳定，需要立刻处理的是快速补液、积极扩容（E对）物理降温（A错）使用糖皮质激素（B错）使用镇静药物（C错）使用血管活性药物（D错）也是中毒性菌痢的治疗措施，但不是立刻处理的。